银化合物治疗牙本质过敏症是利用其
A. 抗菌作用
B. 抗牙菌斑作用
C. 机械性阻塞作用
D. 抑制黏附作用
E. 减少酸产生作用

正确答案：C。机械性阻塞作用

解析：本题考查银化合物治疗牙本质过敏症的机制。牙本质过敏症脱敏治疗的主要原理是封闭牙本质小管，银化合物治疗牙本质过敏症正是利用其能阻塞牙本质小管的特性，即机械性阻塞作用（C对），从而达到阻断传导的目的。